引起“呆小症”的主要原因是患儿身体的哪种激素合成不足
A. 生长素
B. 促生长素
C. 甲状腺素
D. 促甲状腺素
E. 肾上腺素

正确答案：C。甲状腺素